乳牙FC断髓术中，覆盖于牙髓断面的糊剂是
A. 纯氧化锌糊剂
B. 等量的FC和碘仿、氢氧化钙的糊剂
C. 等量的FC和丁香油调拌的氧化锌糊剂
D. 3份丁香油+1份FC调拌的氧化锌糊剂
E. 3份FC+1份丁香油调拌的氧化锌糊剂

正确答案：C。等量的FC和丁香油调拌的氧化锌糊剂

解析：本题考查乳牙FC断髓术。乳牙牙髓切断术是在局麻下去除冠方牙髓组织，用药物如甲醛甲酚（FC）等处理牙髓创面以保存根部健康牙髓组织的方法。术前摄取X线片，麻醉隔湿后去腐、制备洞型，揭髓顶、去冠髓，盖以等量的FC和丁香油调拌的氧化锌糊剂（C对），最后进行充填修复。